完带汤适用于带下病的哪种证候
A. 脾虚
B. 肾阴虚
C. 肾阳虚
D. 湿热
E. 热毒

正确答案：A。脾虚

解析：治疗带下过多脾虚证多健脾益气，升阳除湿。完带汤中的山药、芡实健脾化湿；白果补任固涩止带；车前子利水渗湿；黄柏清热燥湿，使热去湿化，带自止，故此方适用于带下过多脾虚证（A对）。带下过多肾阴虚证多夹湿，方药用知柏地黄汤以滋肾益阴，清热利湿（B错）。带下过多肾阳虚证方药用内补丸（《女科切要》）以温肾培元，固涩止带（C错）。带下过多湿热下注证方药止带方（《世补斋·不谢方》）以清利湿热，佐以解毒杀虫（D错）。带下过多热毒蕴结证多用五味消毒饮（《医宗金鉴》）以清热解毒（E错）。